牙膏中起降低表面张力、增进清洁效果作用的成分是
A. 摩擦剂
B. 洁净剂
C. 润湿剂
D. 芳香剂
E. 防腐剂

正确答案：B。洁净剂

解析：牙膏中的洁净剂：又称发泡剂或表面活化剂，约占1%～2%。它可以降低表面张力，穿通与松解表面沉积物与色素，乳化软垢，刷牙时容易被清除。如月桂醇硫酸钠、十二烷基氨酸钠、椰子单酸甘油酯磺酸钠。掌握“自我口腔保健方法”知识点。